体育锻炼是促进身体发育，增强体质的重要因素之一。以下几点是运动对青少年的影响，不完全正确的是
A. 促进呼吸系统发育。经常参加体育锻炼者呼吸肌发达，胸围扩大，肺通气量、肺活量等显著增加
B. 促进心血管系统发育。经常锻炼的人的心脏收缩力增强，心脏每搏输出量增大
C. 有效调节内分泌，促进青春期正常发育。体育锻炼可推迟女性初潮年龄
D. 控制体重，调节身体成分。经常锻炼的人肌肉显著增加，身体中脂肪含量相应减少
E. 促进运动系统发育。改善肌肉工作的协调性，提高运动能力个技术水平

正确答案：C。有效调节内分泌，促进青春期正常发育。体育锻炼可推迟女性初潮年龄